男，6岁。肾病综合征1个月，近期低盐饮食。于1日前出现无力瘫痪，该患儿出现该种情况是由于
A. 低钾血症
B. 低钙血症
C. 低磷血症
D. 低镁血症
E. 低钠血症

正确答案：E。低钠血症

解析：患儿肾病综合征长期服用排钠利尿剂，加上摄入钠盐少，所以会发生低钠血症（E对）。